疫情的责任报告人包括
A. 医疗保健人员
B. 医疗保健人员和卫生防疫人员
C. 医疗保健人员、个体医生和卫生防疫人员
D. 医疗保健人员、个体医生、卫生防疫人员和饭店职工
E. 医疗保健人员、个体医生、卫生防疫人员和饭店职工、旅店职工

正确答案：C。医疗保健人员、个体医生和卫生防疫人员